全口义齿的前牙要排列成浅覆（牙合），浅覆盖的原因是因为
A. 美观
B. 有利义齿稳定
C. 易于取得前伸（牙合）平衡
D. 为了排牙简单、方便
E. 可以减少前牙牙槽嵴的吸收

正确答案：C。易于取得前伸（牙合）平衡

解析：本题考查全口义齿的前牙要排列成浅覆（牙合）、浅覆盖的原因。前牙要排列成浅覆（牙合）、浅覆盖，则正中（牙合）时前牙不接触，在前伸（牙合）及侧方（牙合）运动时下牙沿上牙斜面在一定范围内自由滑动，易于取得前伸（牙合）平衡（C对），从而保证义齿稳定，即取得前伸（牙合）平衡是义齿稳定（B错）的前提；美观（A错）主要通过使用解剖式牙、瓷牙并结合患者自身的特点实现；为了排牙简单、方便（D错）主要使用非解剖式牙排成线性（牙合）或舌向集中（牙合）实现；为了减少前牙牙槽嵴的吸收（E错）主要是通过合理的设计、准确的制作实现，这些都与排列成浅覆（牙合）、前覆盖无关。